疫疔的致病因素，属
A. 外感六淫邪毒
B. 外来伤害
C. 情志内伤
D. 饮食不节
E. 感受特殊之毒

正确答案：E。感受特殊之毒

解析：疫疔是接触疫畜染毒所致的急性传染性疾病，先有皮肤损伤，而后通过破损的皮肤感染疫毒后发病，而疫毒属于特殊之毒。所以感受特殊之毒是其病因（E对）。外感六淫邪毒，《外科启玄》云：天地有六淫之气，乃风寒暑湿燥火，人感受之则营气不从，变生痈肿疔疖（A错）。外来伤害可引起局部气血凝滞、郁久化热、热胜肉腐等，导致痰血流注、水火烫伤、冻伤、外伤染毒等外伤性疾病（B错）。情志内伤可使体内的气血、经络、脏腑功能失调而发生外科疾病，如形成痰核或引起疼痛等（C错）。饮食不节，恣食膏粱厚味、醇酒炙煿或辛辣刺激之品，可使脾胃功能失调，湿热火毒内生，同时感受外邪则易发生痈、有头疽、疔疮等疾病（D错）。